对重症煤气中毒的昏迷患者，最有效的抢救措施是
A. 鼻导管吸氧
B. 20%甘露醇快速静脉推入
C. 冬眠疗法
D. 血液透析
E. 送入高压氧舱治疗

正确答案：E。送入高压氧舱治疗

解析：CO与HB的亲和力比氧与HB的亲和力大240倍。吸入较低浓度CO即可产生大量COHB。COHB不能携带氧，且不易解离，是氧合血红蛋白解离速度的1/3600。COHB的存在还能使血红蛋白氧解离曲线左移。血氧不易释放给组织而造成细胞缺氧。同时CO能与体内还原型细胞色素氧化酶的二价铁结合，抑制此酶的活性，影响细胞呼吸和氧化过程阻碍细胞对氧的摄取。煤气中毒使患者昏迷的主要原因是缺氧，最有效的抢救措施就是使患者立即改变缺氧症状，对于重症煤气中毒的昏迷患者，最有效的抢救措施是迅速纠正组织缺氧，缩短昏迷时间和病程，预防一氧化碳中毒引发的迟发性脑病，故需要进行高压氧舱（E对）治疗。